关于成分输血的描述，错误的是
A. 减少输血传播传染病的发生
B. 治疗效果不如全血好
C. 输血不良反应少
D. 节约血液资源
E. 便于保存和使用

正确答案：B。治疗效果不如全血好

解析：成分输血的有效成分含量高、治疗针对性强、效率高、治疗效果较全血好（B错，为本题正确答案），且节约血源（D对）。由于成分血中有效成分单一，便于保存和使用（E对），输血不良反应少（C对）。全血中包含白细胞、红细胞、血小板、血浆等，成分复杂，其中白细胞传播病毒的危险性最大，其次是血浆，成分输血可减少不必要的血液成分的输注，减少输血传播疾病的发生（A对）。